下列有关甲肝病毒的叙述，正确的是
A. 为嗜肝DNA病毒
B. 只有一个血清型
C. 60℃30分钟可被灭活
D. 对紫外线照射不敏感
E. 只有1个基因型

正确答案：B。只有一个血清型

解析：在血清型方面，甲肝病毒能感染人的血清型只有1个（B对），因此只有1个抗原-抗体系统。甲肝病毒属微小RNA病毒科嗜肝RNA病毒属（A错）。甲肝病毒能耐受60℃30分钟，80℃5分钟或100℃1分钟才能完全使之灭活（C错）。对紫外线、氯、甲醛等敏感（D错）。甲肝病毒可分为7个基因型，其中Ⅰ、Ⅱ、Ⅲ、Ⅶ型来自人类，Ⅳ、V、Ⅵ型来自猿猴（E错）。目前我国已分离的HAV均为Ⅰ型。